龈沟液的主要成分来自
A. 血液
B. 血清
C. 血浆
D. 邻近的牙周组织
E. 细菌

正确答案：B。血清

解析：本题考查龈沟液的主要成分。龈沟液是指通过龈沟内上皮和结合上皮从牙龈结缔组织渗入到龈沟内的液体。牙龈炎症明显时龈沟夜增多。龈沟液的成分主要来自于血清（B对AC错），其他成分则分别来自血清、邻近的牙周组织（D错）（上皮、结缔组织）及细菌（E错）。